医学模式的核心是
A. 健康观
B. 价值观
C. 疾病观
D. 医学观
E. 医学理论

正确答案：D。医学观